成组设计两样本比较秩和检验中，当两组间出现相同观察值时，编秩方法是
A. 舍去不计
B. 取较小秩次
C. 取较大秩次
D. 取其平均秩次
E. 不必平均

正确答案：D。取其平均秩次